宜用均数和标准差进行统计描述的资料是
A. 正态分布资料
B. 对数正态分布资料
C. 正偏态分布资料
D. 负偏态分布资料
E. 两端无确切值的资料

正确答案：A。正态分布资料

解析：本题考查均数与标准差相关内容。标准差一般与均数结合使用，描述不含离群值的对称分布的分布特征（A对BCDE错）。